影响药物进入中枢神经系统发挥作用的因素是
A. 首过效应
B. 肝肠循环
C. 血脑屏障
D. 胎盘屏障
E. 血眼屏障

正确答案：C。血脑屏障

解析：本题考查影响药物分布的因素。血脑屏障（C对）是血液与脑组织之间的屏障，只有脂溶性较高的药物才能透过血脑屏障进入脑组织，血脑屏障阻碍了很多药物进入中枢；首过效应（A错）是指药物在尚未吸收进入血液循环之前，在肠黏膜和肝脏被代谢而使进入血液循环的原形药量减少的现象；肠肝循环（B错）是指随胆汁排入十二指肠的药物或其代谢物，在肠道中重新被吸收，经门静脉又返回肝脏的现象；胎盘屏障（D错）是将母体与胎儿血液隔开的屏障；血眼屏障（E错）是血液与眼部的房水、晶状体和玻璃体等组织之间存在着的屏障。